初产妇，妊娠37周，8小时前突然出现阴道流液，如尿样，6小时前开始出现规律宫缩，因胎手脱出于阴道口2小时就诊，查体：产妇烦躁不安，腹痛拒按，脉搏110次/分，呼吸28次/分，胎心160次/分，导尿时血尿。诊断首先考虑
A. 胎膜早破
B. 子宫破裂
C. 先兆子宫破裂
D. 前置胎盘
E. 胎盘早剥

正确答案：C。先兆子宫破裂

解析：该初产妇，妊娠37周（为足月产）。胎膜破，出现规律宫缩，因胎手脱出于阴道口2小时就诊（为肩难产征象，说明该患者存在梗阻性难产因素）。查体：产妇烦躁不安，腹痛拒按（先兆早产的产妇出现烦躁不安，呼吸、心率加快，下腹剧痛难忍），脉搏110次/分（＞100次/分，为心动过速），呼吸28次/分（＞24次/分，呼吸加快），胎心160次/分（胎心率在正常范围），导尿时血尿（排膀胱受压充血，出现尿困难及血尿），诊断首先考虑先兆子宫破裂（C对）。子宫破裂（P219）（B错）分为不完全性子宫破裂和完全性子宫破裂，不完全性子宫破裂是子宫肌层部分或全层破裂，但浆膜层完整，宫腔与腹腔不相通，胎儿及其附属物仍在宫腔内；完全性子宫破裂是子宫肌壁全层破裂，宫腔与腹腔相通，产妇突感下腹一阵撕裂样剧痛，子宫收缩骤然停止，但无先兆子宫破裂的典型症状。胎膜早破（P213）（A错）90﹪患者突感有较多液体从阴道流出，有时可混有胎脂及胎粪，无腹痛、尿血等症状。前置胎盘（P127）（D错）典型症状是妊娠晚期或临产时，发生无诱因、无痛性反复阴道流血。胎盘早剥（P129）（E错）典型症状为妊娠中期突发持续性腹痛，伴或不伴阴道流血，严重时出现休克、弥散性血管内凝血。